肝体积明显缩小，外观黄绿色，表面呈结节状，光镜下见肝细胞大片坏死，同时可见肝细胞再生结节，明显淤胆，大量炎症细胞浸润，结节间纤维组织及小胆管明显增生，根据上述病变应诊断为
A. 急性黄疸性普通型肝炎
B. 重度慢性肝炎
C. 急性重型肝炎
D. 亚急性重型肝炎
E. 门脉性肝硬化

正确答案：D。亚急性重型肝炎

解析：肝体积明显缩小，外观黄绿色，表面呈结节状，光镜下见肝细胞大片坏死，同时可见肝细胞再生结节，明显淤胆，大量炎症细胞浸润，结节间纤维组织及小胆管明显增生，应诊断为亚急性重型肝炎（D对）。急性黄疸性普通型肝炎（A错）（P198）的主要病变为光镜下见肝细胞胞质疏松淡染和气球样变，坏死轻微，肝小叶内可见点状坏死与嗜酸性小体，肝小叶内与汇管区可见轻度炎细胞浸润。重度慢性肝炎（B错）（P198）的主要病变为光镜下见重度的碎片状坏死与大范围的桥接坏死。急性重型肝炎（C错）（P199）的主要病变为肝细胞体积明显缩小，质地柔软，面呈黄色或红褐色，光镜下见肝细胞坏死广泛而严重，肝细胞索解离、溶解，出现弥漫性大片坏死。门脉性肝硬化（E错）（P201）的主要病变为光镜下见假小叶形成。